严重心肌炎引起心力衰竭的主要机制是
A. 心肌能量生成障碍
B. 心肌能量利用障碍
C. 心肌能量储存障碍
D. 心肌兴奋-收缩耦联障碍
E. 心肌收缩蛋白破坏

正确答案：E。心肌收缩蛋白破坏

解析：严重心肌炎可直接导致心肌细胞变性、坏死，使心肌收缩蛋白破坏（E对），心肌收缩性降低，久之可发生心衰。